妊娠期妇女使用可致胎儿永久性耳聋的药品是
A. 氨基糖苷类
B. 氮芥类
C. 甲巯咪唑
D. 头孢菌素类
E. 胰岛素

正确答案：A。氨基糖苷类

解析：本题考查氨基糖苷类的不良反应。氨基糖苷类（A对）抗生素的典型不良反应为耳毒性，妊娠期妇女使用可致胎儿永久性耳聋。氮芥类（B错）为烷化剂，妊娠早期妇女使用可引起泌尿生殖系统异常，指趾畸形。甲巯咪唑（C错）为抗甲状腺药，妊娠期妇女使用可致胎儿甲状腺功能低下。头孢菌素（D错）尚未见发生问题的报告，但仍需慎用。胰岛素（E错）在妊娠期应用时，应尽量使用生物合成的人胰岛素，动物源性的胰岛素不建议使用。